有下列疾病的人，不得从事粉尘作业
A. 活动性肺结核
B. 支气管哮喘
C. 慢性胃炎
D. 严重心脏疾病
E. 以上全部

正确答案：E。以上全部

解析：本题考查粉尘作业。在粉尘作业人员职业健康检查中，发现劳动者患有下列疾病的，不宜从事粉尘作业，应及时调离粉尘作业岗位：1.活动性肺结核病；2.慢性阻塞性肺病；3.慢性间质性肺病；4.伴肺功能损害的疾病；5.严重的慢性呼吸道疾病如萎缩性鼻炎、鼻腔肿瘤、支气管哮喘、支气管扩张、慢性支气管炎等；6.严重的心脏疾病（E对ABCD错）。